患儿，女，1岁。发热3天，咳嗽渐重，体温38.5℃，查体双肺下部中细湿啰音。查血：白细胞12X10⁹/L，N75%。胸部照片示双下肺点片状阴影。口渴烦躁，小便黄少，舌红而干，苔黄。其合理治法是
A. 青霉素加三拗汤
B. 青霉素加麻杏石甘汤
C. 病毒唑加三拗汤
D. 病毒唑加银翘散
E. 以上均不是

正确答案：B。青霉素加麻杏石甘汤

解析：据本病例患儿出现发热、咳嗽，查体：双肺下部中细湿啰音，胸片示双下肺点片状阴影，可明确诊断为肺炎，化验血白细胞总数及中性粒细胞增高提示细菌性肺炎，治疗首选用青霉素、羟氨苄青霉素等。根据患儿咳嗽，口渴烦躁，小便黄少，舌红而干，苔黄，可判断有邪热壅肺，故当治以清泻肺热、止咳喘，宜选清肺平喘的麻杏石甘汤（B对）。三拗汤，功专宣肺散寒、止咳平喘，主治风寒犯肺证（AC错）。病毒唑属于抗病毒药，适用于病毒性肺炎（DE错）。